对药物治疗无效的反复发作室性心动过速/心室颤动的心力衰竭患者，最适宜的治疗为
A. 服用阿托品
B. 植入性心脏转复除颤器
C. 服用奎尼丁
D. 安置房室顺序起搏器
E. 静注维拉帕米

正确答案：B。植入性心脏转复除颤器

解析：对于药物治疗无效的反复发作室性心动过速/心室颤动的心衰患者，临床上应使用植入性心脏转复除颤器（B对）治疗。心脏转复除颤器同时具备抗心动过缓起搏、抗心动过速起搏和低能电转复以及高能电除颤多种功能。对本例患者的治疗包括：一方面在患者自发心室颤动时可以及时除颤，另一方面当患者突发心脏骤停时可及时起搏。阿托品（A错）适用于缓慢型心律失常和房室传导阻滞。奎尼丁（P190）（C错）可在心房扑动和心房颤动时转复窦性心律，但也可诱发致命性室性心动过速，增加死亡率，目前已少用。房室顺序起搏器又称双腔起搏器（P161），是指在右心房和右心室内放置两根导线，按顺序起搏心房和心室。主要用于病态窦房结综合征和高度房室传导阻滞患者。故安置房室顺序起搏器（D错）不适合于本例患者。维拉帕米（P206）（E错）为非二氢吡啶类钙通道拮抗剂，主要适用于各种室上性心动过速，房室折返性心动过速等。